其病因属感受特殊之毒的是
A. 红丝疔
B. 失荣
C. 漆疮
D. 水火烫伤
E. 酒渣鼻

正确答案：C。漆疮

解析：红丝疔为外因为手足生疔，或足癣糜烂，或皮肤破损感染毒邪，内因为火毒凝聚（A错）。失荣为情志内伤所致（B错）。漆疮为接触生漆所致，为特殊之毒所致（C对）。水火烫伤为外来伤害所致（D错）。酒渣鼻为饮食不节加之复感风寒所致（E错）。